用于治疗外周血管痉挛性疾病的药物是
A. 异丙肾上腺素
B. 多巴胺
C. 酚妥拉明
D. 阿托品
E. 肼屈嗪

正确答案：C。酚妥拉明

解析：酚妥拉明（C对）属于短效的α受体阻断剂，通过阻断α受体以及对血管的直接舒张作用而使血管扩张，血压下降，反射性兴奋交感神经，引起心脏兴奋，心输出增加，临床可用于外周血管痉挛性疾病 如肢端动脉痉挛性疾病（如雷诺症）及血栓闭塞性脉管炎。异丙肾上腺素（A错）属于β受体激动剂，临床主要用于支气管哮喘、房室传导阻滞、心脏骤停。多巴胺（B错）主要用于治疗各种休克，如心源性休克、感染性休克和出血性休克，尤其适用于伴有心肌收缩力减弱、尿量减少而血容量已补足的休克。阿托品（D错）为胆碱受体阻断剂，许多血管床缺乏明显的胆碱能神经神经支配，治疗剂量的阿托品对血管和血压无影响，大剂量对痉挛的微血管具有解痉的作用。肼屈嗪（E错）能干预血管平滑肌钙离子内流，直接舒张小动脉平滑，使外周阻力降低，血压下降，可用于中、重度高血压。